肺结核所致支气管扩张最好发的部位是
A. 上叶尖后段
B. 上叶前段
C. 右中叶
D. 左舌叶
E. 下叶基底段

正确答案：A。上叶尖后段

解析：支气管扩张可发生于肺内各个部位。一般感染引起下叶（左侧更多见）、右中叶和左舌叶支气管扩张；结核常引起上叶尖后段支（A对）气管扩张。（北京大学医学出版社内科学P87）。